因小叶纤维细胞对雌激素敏感性异常增生而引起的疾病是
A. 乳腺癌
B. 乳管内乳头状瘤
C. 乳房肉瘤
D. 乳房纤维腺瘤
E. 乳腺囊性增生病

正确答案：D。乳房纤维腺瘤

解析：乳房纤维腺瘤（D对）产生的原因是小叶内纤维细胞对雌激素的敏感性异常增高，可能与纤维细胞所含雌激素受体的量或质的异常有关，是青年女性常见的乳房肿瘤。乳腺癌（A错）是女性最常见的恶性肿瘤之一，病因尚不清楚。乳管内乳头状瘤（B错）是指发生在导管上皮的良性肿瘤。乳房肉瘤（C错）是较少见的恶性肿瘤，包括中胚叶结缔组织来源的间质肉瘤、纤维肉瘤、血管肉瘤和淋巴肉瘤等。乳腺囊性增生病（E错）是因雌、孕激素比例失调，使乳腺实质增生过度和复旧不全而导致的。